男，30岁，四肢、躯干重度烧伤，6天后高热、谵妄，周身皮疹，创面有较多黄稠脓性分泌物。此时应考虑
A. 金葡菌感染败血症
B. 链球菌感染败血症
C. 大肠杆菌感染败血症
D. 绿脓杆菌感染败血症
E. 真菌性败血症

正确答案：E。真菌性败血症

解析：真菌性败血症：由真菌引起，常见致病菌是白色念珠菌，往往发生在原有细菌感染经广谱抗生素治疗的基础上，其临床表现酷似革兰阴性杆菌败血症，突然发生寒战、高热、神志淡漠、嗜睡、血压下降和休克。掌握“外科感染”知识点。